甲药品零售连锁企业，经营范围：化学药、第二类精神药品、中成药、中药饮片、生物制品。甲下辖若干连锁门店，该企业制定的体系文件规定实施统一采购配送、统一质量管理、统一财务管理、统一计算机系统、统一药学服务。乙门店为甲的所属门店，且为医疗保险定点零售药店，经营类别：处方药、甲类非处方药、乙类非处方药；经营范围：化学药、第二类精神药品、中成药、中药饮片。丙药品零售企业（非连锁门店），经营类别：处方药、甲类非处方药、乙类非处方药；经营范围：化学药、中成药、中药饮片。（1）甲拟新开设一家连锁门店，仅经营乙类非处方药，当地药品监督管理部门决定对其审批实行告知承诺制。（2）2021年1月，甲开办一家连锁门店，同年2月该门店申请成为医疗保险定点零售药店。（3）2019年4月，丙从戊药品生产企业购进一批中成药，该批药品系药品上市许可持有人委托戊生产，丙持有戊提供的药品上市许可持有人与戊签订的委托生产销售协议。（4）2020年8月，丙从己药品上市许可持有人处购进批生物制品。上述行为符合国家有关管理规定的有
A. （1）（3）
B. （1）（2）
C. （2）（3）
D. （2）（4）

正确答案：A。（1）（3）

解析：本题考查药品经营许可证核发和依法自行销售或委托销售的主要内容。上述行为符合国家有关管理规定的有（1）（3）（A对）。根据《国家药监局关于当前药品经营监督管理有关事宜的通告》（2020年第23号）的规定，新开办药品经营企业申请核发《药品经营许可证》的，药品监督管理部门可将筹建和验收程序合并执行。依法自行销售或委托销售：药品药品上市许可持有人可以自行销售其取得药品注册证书的药品，也可以委托药品经营企业销售。药品上市许可持有人从事药品零售活动的，应当取得药品经营许可证。药品上市许可持有人自行销售药品的，应当具备《药品管理法》第五十二条规定的条件；委托销售的，应当委托符合条件的药品经营企业。药品上市许可持有人和受托经营企业应当签订委托协议，并严格履行协议约定的义务。基本医疗保险定点医疗机构和定点零售药店根据与医疗保障经办机构签订的协议，可以在本机构中医疗保障办理场所使用医保官方标志（BCD错）。